生物富集作用指的是
A. 水中有机物分解的过程中溶解氧被消耗的同时，空气中的氧通过水而不断溶解于水中而补充水体的氧
B. 水中化学污染物经水中微生物作用成为毒性更大的新的化合物
C. 经食物链途径最终使生物体内污染物浓度大大超过环境中的浓度
D. 水中污染物吸收光能发生分解
E. 水中有机物过多水体变黑发臭

正确答案：C。经食物链途径最终使生物体内污染物浓度大大超过环境中的浓度

解析：本题考查生物富集作用。生物富集作用指的是经食物链途径最终使生物体内污染物浓度大大超过环境中的浓度（C对ABDE错）。